白细胞分类中，中性粒细胞与淋巴细胞的比例大致相等的时间是
A. 生后2～4天及2～4个月
B. 生后4～6个月及4～6岁
C. 生后4～6个月及6～8岁
D. 生后4～6天及4～6个月
E. 生后4～6天及4～6岁

正确答案：E。生后4～6天及4～6岁

解析：白细胞分类中，中性粒细胞与淋巴细胞的比例大致相等的时间是4-6天和4-6岁（E对）。